以颜色命名的外科疾病是
A. 颈痈
B. 委中毒
C. 蛇头疔
D. 丹毒
E. 破伤风

正确答案：D。丹毒

解析：本题考查疾病的命名原则。颈痈是以部位命名的（A错）。委中毒是以穴位命名的（B错）。蛇头疔是以形态命名的（C错）。丹毒是以患部皮肤突然发红成片、色如涂丹而命名的，以颜色命名（D对）。破伤风以疾病特征命名（E错）。